人命至重，有贵千金，这句话是谁说的
A. 希腊医生希波克拉底
B. 唐代孙思邈
C. 明代李天成
D. 东汉华佗
E. 东汉张仲景

正确答案：B。唐代孙思邈

解析：“人命至重，有贵千金，一方济之，德逾于此”这句名言是由唐代孙思邈（B对）提出的。